心包积液时，心浊音界改变为
A. 心界向左侧增大
B. 心界呈靴形
C. 心界呈梨形
D. 坐位心界呈三角形烧瓶样，卧位心底部浊音界增宽
E. 心界向左下增大

正确答案：D。坐位心界呈三角形烧瓶样，卧位心底部浊音界增宽

解析：心包积液时，心浊音界改变为坐位心界呈三角形烧瓶样，卧位心底部浊音界增宽（D对）。高血压引起的心室肥厚会表现为心界向左侧增大（A错）。心界呈靴形常见于主动脉关闭不全，也可见于主动脉瓣狭窄（B错）。心界呈梨形常见疾病有二尖瓣病变、房间隔缺损、肺动脉瓣狭窄、肺动脉高压和肺心病等（C错）。心界向左下增大提示左心室肥厚（E错）。